将经过临床和实验室检查确诊为急性细菌性感染的患者，按设定的随机数字表分别纳入氟罗沙星实验组和氧氟沙星对照组，来评价氟罗沙星治疗细菌性感染的效果。该研究为
A. 队列研究
B. 病例对照研究
C. 临床试验
D. 社区干预试验
E. 现场试验

正确答案：C。临床试验